刺激性气体所引起的肺水肿分为
A. 刺激期、肺水肿期、恢复期、痊愈
B. 刺激期、潜伏期、肺水肿期、恢复期
C. 眩晕期、诱导期、肺水肿期、恢复期
D. 刺激期、眩晕期、肺水肿期、恢复期
E. 诱导期、潜伏期、肺水肿期、恢复期

正确答案：B。刺激期、潜伏期、肺水肿期、恢复期

解析：本题考查刺激性气体引起的肺水肿分期。刺激性气体引起的肺水肿，临床过程可分为四期：（1）刺激期，吸入刺激性气体后表现为气管-支气管黏膜的急性炎症；（2）潜伏期，刺激期后，自觉症状减轻或消失，病情相对稳定，但肺部的潜在病理变化仍在继续发展，经过一段时间发生肺水肿，实属“假象期”；（3）肺水肿期，潜伏期之后，突然出现加重的呼吸困难，烦躁不安、大汗淋漓、剧烈咳嗽、咳大量粉红色泡沫样痰；（4）恢复期，经正确治疗，如无严重并发症，肺水肿可在2～3天内得到控制，症状体征逐步消失（B对ACDE错）。